佐匹克隆可用于治疗
A. 失眠
B. 抑郁症
C. 帕金森病
D. 阿尔茨海默病
E. 精神分裂症

正确答案：A。失眠

解析：本题考查佐匹克隆。佐匹克隆属于环吡咯酮类第三代催眠药，适用于各种失眠（A对）；抑郁症（B错）需要用氟西汀、舍曲林等抗抑郁药治疗；帕金森病（C错）和阿尔茨海默病（D错）为脑功能退行性疾病；精神分裂症（E错）可用抗精神分裂药物如氯丙嗪、奋乃静等治疗；佐匹克隆不用于治疗精神分裂症。